原动物属于螳螂科的药材是
A. 鸡内金
B. 斑蝥
C. 土鳖虫
D. 海螵蛸
E. 桑螵蛸

正确答案：E。桑螵蛸

解析：本题考查的桑螵蛸的来源。原动物属于螳螂科的药材是桑螵蛸（E对）。桑螵蛸：【来源】为节肢动物门昆虫纲螳螂科昆虫大刀螂、小刀螂或巨斧螳螂的干燥卵鞘。鸡内金（A错）：【来源】为脊索动物门鸟纲雉科动物家鸡的干燥沙囊内壁。斑蝥（B错）：【来源】为节肢动物门昆虫纲芫青科昆虫南方大斑蝥或黄黑小斑蝥的干燥体。土鳖虫（C错）：【来源】为节肢动物门昆虫纲鳖蠊科昆虫地鳖或冀地鳖的雌虫干燥体。海螵蛸（D错）：【来源】为软体动物门乌贼科动物无针乌贼或金乌贼的干燥内壳。